胸腔大量积气患者触觉语颤表现的是
A. 增强
B. 减弱或消失
C. 稍增强
D. 正常
E. 无变化

正确答案：B。减弱或消失

解析：胸腔大量积气患者触觉语颤表现的是语颤减弱或消失（B对）。语颤增强或稍增强主要见于大叶性肺炎、大片肺梗死、空洞型肺结核、肺脓肿等（AC错）。语颤正常或无变化见于肺部无疾病的患者（DE错）。